在临床医学研究中必须尊重受试者的知情同意权，下面做法中错误的是
A. 必须获得受试者的知情同意
B. 无行为能力者需获得代理同意
C. 获得同意前需要用受试者能够理解的语言向受试者提供基本的信息
D. 禁止用欺骗的手法获得受试者同意
E. 可以利诱受试者，让他同意

正确答案：E。可以利诱受试者，让他同意